甲药品研究所研制了一种化学创新药，已成功获得药品注册证书，成为药品上市许可持有人。为使该新药尽快上市，甲委托乙化学药品生产企业生产该药品，同时委托具备相应经营范围的丙药品经营企业销售该药品。两年后，甲决定自行生产该药品。关于甲下列行为的说法，正确的是
A. 委托丙以外的另一家具备相应经营范围的药品经营企业销售该药品
B. 委托乙以外的另一家大型中成药生产企业生产该药品
C. 委托乙的质量负责人履行该药品的质量管理职责
D. 委托药品检验所负责该药品的质量检验和放行

正确答案：A。委托丙以外的另一家具备相应经营范围的药品经营企业销售该药品

解析：本题考查药品上市许可持有人的权力和义务。甲药品研究所研制了一种化学创新药，已成功获得药品注册证书，成为药品上市许可持有人。为使该新药尽快上市，甲委托乙化学药品生产企业生产该药品，同时委托具备相应经营范围的丙药品经营企业销售该药品。两年后，甲决定自行生产该药品。关于甲下列行为的说法，正确的是委托丙以外的另一家具备相应经营范围的药品经营企业销售该药品（A对）。药品上市许可持有人自行生产药品的，应当依照本法规定取得药品生产许可证；委托生产的，应当委托符合条件的药品生产企业（B错）。药品上市许可持有人自行销售药品的，应当具备本法第五十二条规定的条件；委托销售的，应当委托符合条件的药品经营企业。药品上市许可持有人应当建立药品质量保证体系，配备专门人员独立负责药品质量管理（C错）。药品上市许可持有人应当建立药品上市放行规程，对药品生产企业出厂放行的药品进行审核，经质量受权人签字后方可放行（D错）。不符合国家药品标准的，不得放行。